CM是指
A. 运送内源性TG
B. 运送内源性Ch
C. 运送外源性TG
D. 蛋白质含量最高
E. 与冠状动脉粥样硬化的发生率呈负相关

正确答案：C。运送外源性TG

解析：乳糜微粒CM：主要含有外源性甘油三酯，是运输外源性甘油三酯（TG）及胆固醇的主要形式。掌握“甘油磷脂、胆固醇和血脂蛋白代谢”知识点。